女性，60岁。反复咳嗽、咳痰25年，心悸、气促、下肢间歇水肿3年，病情加重伴畏寒发热1周入院。体检：T38℃，呼吸急促，口唇发绀，双肺叩诊过清音，中下肺有湿啰音，心率110次/分，心律齐，无杂音，双下肢重度水肿。主要治疗措施为
A. 控制感染与改善呼吸功能
B. 祛痰与止咳
C. 解痉与平喘
D. 低浓度持续吸氧
E. 给予利尿剂和强心剂

正确答案：A。控制感染与改善呼吸功能

解析：患者老年女性，反复咳嗽、咳痰25年（为慢阻肺的标志性症状），查体双肺叩诊过清音，诊断为慢性阻塞性肺疾病（COPD）。有下肢间歇水肿病史3年，查体双下肢重度水肿，表明已出现右心衰竭，考虑慢性肺源性心脏病。病情加重伴畏寒发热，说明为慢性肺心病急性加重期，最重要的治疗措施为控制感染与改善呼吸功能（A对），因为呼吸系统感染是引起慢性肺心病急性加重致肺、心功能失代偿的常见原因。祛痰与止咳（B错）为一般性治疗措施，不是最主要的。解痉与平喘（C错）主要用于支气管哮喘的治疗。低浓度持续吸氧（D错）可改善体内的缺氧状态，适用于心肺功能代偿期的治疗，不适用已发生右心衰的患者。在应用利尿剂之后，易出现低钾低氯性碱中毒，痰液粘稠不易排出和血液浓缩，由于慢性缺氧及感染，对强心剂药物的耐受极低，易中毒，出现心律失常，故应慎用利尿剂和强心剂（E错）。